评价管网是否出现二次污染的指标
A. 细菌总数
B. 总大肠菌群
C. 粪大肠菌群
D. 游离性余氯
E. BOD

正确答案：D。游离性余氯

解析：本题考查评价管网是否出现二次污染的指标。管网水出现二次污染时，游离氯（D对ABCE错）会耗尽。